血管紧张素转换酶抑制剂最适用的临床情况
A. 高血压伴主动脉狭窄
B. 妊娠期高血压
C. 高血压伴左心室肥厚
D. 高血压伴高血钾症
E. 高血压伴双肾动脉狭窄

正确答案：C。高血压伴左心室肥厚

解析：血管紧张素转换酶抑制剂（ACEI）通过抑制ACE减少血管紧张素Ⅱ（ATⅡ）生成而抑制RAAS，并通过抑制缓激肽降解而增强缓激肽活性及缓激肽介导的前列腺素生成，发挥降压作用；也可通过降低心衰患者神经-体液代偿机制的不利影响，改善心室重塑，因此最适用于高血压伴左心室肥厚（C对）。ACEI及β受体拮抗剂不适用于主动脉瓣狭窄患者（P297）。这是因为主动脉瓣狭窄时，左心室射血减少，引起血压下降，机体为了保持重要脏器的血流灌注，通过激活神经体液机制，让外周血管收缩，来维持灌注压。如果使用了以上两种药会造成左室舒张末压过度下降，导致心排出量减少，引起直立性低血压。因此血管紧张素转换酶抑制剂不适用于高血压伴主动脉狭窄患者（A错）。高钾血症、妊娠妇女和双侧肾动脉狭窄患者禁用血管紧张素转换酶抑制剂（BDE错）。